男，28岁。1个月来3次无明显诱因突发心悸，胸闷、窒息感，浑身冷汗，感觉自己快不行了，极度紧张害怕，持续10余分钟，每次去医院急诊，除心电图是窦性心动过速外，余无异常，事后总担心下次再发作。该患者做可能的诊断是
A. 广泛性焦虑障碍
B. 恐惧性障碍
C. 分离性障碍
D. 惊恐障碍
E. 心脏病所致焦虑障碍

正确答案：D。惊恐障碍

解析：该男性患者近1个月来突发心悸，胸闷、窒息感，浑身冷汗，感觉自己快不行了（濒死感），极度紧张害怕，考虑急性焦虑性障碍（惊恐障碍）（D对）。广泛性焦虑障碍（GAD）（A错）是一种以焦虑为主要临床表现的精神障碍，患者常常有不明原因的提心吊胆、紧张不安，并有显著的自主神经功能紊乱症状、肌肉紧张及运动性不安，与本例不符。恐惧性障碍（恐惧症）（B错）以焦虑为核心症状，恐惧症的焦虑由特定的对象或处境引起，呈境遇性和发作性，而焦虑障碍的焦虑常没有明确的对象，常持续存在。分离性障碍（C错）的共同特点是部分或全部丧失了对过去的记忆或身份，或出现具有发泄特点的情感爆发。心电图除心电图是窦性心动过速外，余无异常，故排除心血管疾病（E错）。